关于斑釉牙的发病机制和病理说法不正确的是
A. 当氟浓度过高时，碱性磷酸酶活性降低
B. 表层釉质呈多孔性
C. 釉柱间质矿化不良，釉柱过度矿化
D. 氟对牙本质的影响大于对釉质的影响
E. 氟斑的产生是因吸附外来色素

正确答案：D。氟对牙本质的影响大于对釉质的影响

解析：本题考查斑釉牙的发病机制和病理。氟主要损害釉质发育期牙胚的成釉细胞，对釉质的损害大于对牙本质的损害（D错，为本题的正确答案）。当氟浓度过高时，可抑制碱性磷酸酶的活性（A对），从而造成釉质发育不良、矿化不全和骨质变脆等骨骼疾患。氟牙症表层釉质呈多孔性（B对），易吸附外来色素而产生氟斑（E对）。病理表现为柱间质矿化不良和釉柱的过度矿化（C对）。